烘烤含挥发油的饮片时，温度不宜超过
A. 80℃
B. 70℃
C. 60℃
D. 40℃
E. 35℃

正确答案：C。60℃

解析：本题考查的是高温养护法。烘烤含挥发油的饮片时，温度不宜超过60℃（C对）。高温养护法：中药蛀虫对高温的抵抗力均很差，因此采用高温（如暴晒或烘烤）贮存中药饮片，可有效地防止虫害的侵袭。一般情况下温度高于40℃（DE错），蛀虫就停止发育、繁殖，当温度高于50℃时，蛀虫将在短时间内死亡。但必须注意的是，含挥发油的饮片烘烤时温度不宜超过60℃（AB错），以免影响饮片的质量。